女孩青春期生长突增开始的年龄
A. 9～11岁
B. 8～10岁
C. 10～12岁
D. 8～12岁
E. 9～12岁

正确答案：A。9～11岁

解析：本题考查女孩青春期的特点。青春期是指人体生长发育成熟前一个迅速发育的阶段，大致可分为青春早期、中期、后期。青春早期：女孩从第二性征初现至月经初潮时止，年龄为9～11岁（A对BCDE错），以体格生长突增为主。